晚期卵巢癌的首选治疗方法是
A. 肿瘤切除术
B. 肿瘤细胞减灭术+化学治疗
C. 激素治疗
D. 化学治疗
E. 放射治疗

正确答案：B。肿瘤细胞减灭术+化学治疗

解析：晚期卵巢癌的首选治疗方法是肿瘤细胞减灭术+化学治疗（B对）。尤其是对于评估无法达到满意手术的Ⅲ、Ⅳ期患者，在获得明确的组织学诊断后可先行2～3个疗程的新辅助化疗后再进行手术。肿瘤切除术（P327）（A错）主要适用于Ⅰ期患者。化学治疗（P327）（D错）主要用于初次手术后辅助化疗，以杀灭残留癌灶、控制复发，以缓解症状、延长生存期。放射治疗（P328）（E错）对卵巢癌的治疗价值有限，对于复发患者可选用姑息性局部放疗。激素治疗（C错）不用于卵巢癌的治疗。